丘脑出血（内囊内侧型)的体征是
A. 高热
B. 脑膜刺激征明显
C. 脑脊液大多正常
D. “三偏”征
E. 抽搐

正确答案：D。“三偏”征

解析：丘脑出血（内囊内侧型)的体征是对侧偏瘫、偏盲、偏身感觉障碍，即“三偏”征（D对），脑脊液为血性（C错），常无高热（A错）、脑膜刺激征（B错）及抽搐（E错）。